阿托品的作用机制是
A. 影响机体免疫功能
B. 影响酶活性
C. 影响细胞膜离子通道
D. 阻断受体
E. 干扰叶酸代谢

正确答案：D。阻断受体

解析：本题考查药物的作用机制。阿托品的作用机制是阻断受体（D对）。大多数药物作用于受体发挥药理作用。例如阿托品阻断副交感神经末梢支配效应器细胞上的M胆碱受体发挥抑制腺体分泌、松弛内脏平滑肌、扩瞳、升高眼内压、调节麻痹、加快心率、抑制胃液分泌的药理作用。影响机体免疫功能（A错）免疫抑制药环孢素及免疫增强药左旋咪唑的作用机制。影响酶活性（B错）是抗高血压药物依那普利和解热、镇痛、抗炎药阿司匹林等的作用机制。影响细胞膜离子通道（C错）是局麻药利多卡因、钙通道阻滞药硝苯地平等的作用机制。干扰叶酸代谢（E错）是磺胺类抗菌药、喹诺酮类抗菌药的作用机制。